以下哪项不属于固定桥的适应证
A. 单颗前牙缺失
B. 咬合关系正常
C. 基牙牙周组织健康
D. 前牙缺失伴大量骨缺损
E. 对颌牙正常

正确答案：D。前牙缺失伴大量骨缺损

解析：本题考查固定桥的适应证。前牙缺失伴大量骨缺损（D错，为本题正确答案）不属于固定桥的适应证。固定桥修复对缺牙区剩余牙槽嵴的要求是愈合良好，形态基本正常，对于有大量骨缺损的患者，需在颌面骨缺损修复以后再行义齿修复。固定桥的（牙合）力主要由缺牙区两侧或一侧的基牙承担，所有基牙共同分担桥体的（牙合）力，故固定桥最适合于牙弓内的少数牙缺失，或者少数牙的间隔缺失，如单颗前牙缺失（A对）。如为间隔的少数牙缺失，可增加中间基牙作支持。对多数牙的间隔缺失，应持谨慎态度。要求缺牙区的咬合关系正常（B对），缺牙间隙有适当的（牙合）龈高度，对颌牙正常（E对），有良好的颌间锁结关系，缺隙侧邻牙无倾斜移位。如果邻牙倾斜，对颌牙伸长，只要能采取措施，调（牙合）磨短伸长牙，或调磨基牙倾斜面，或改变固位体的设计，均可以制作固定桥。基牙要承担自身的和桥体的（牙合）力，必须要求基牙牙周组织健康（C对），只要牙周无不可治愈的炎症，无病理性动度，牙槽骨吸收不超过根长的1/3即可设计制作固定桥。